我国规定1岁内必须完成的计划免疫是
A. 卡介苗
B. 乙脑疫苗
C. 流脑疫苗
D. 流感疫苗
E. 甲肝疫苗

正确答案：A。卡介苗

解析：按照我国卫生部规定（P29），计划免疫必须在1岁内完成卡介苗（A对），脊髓灰质炎，百日咳、白喉、破伤风类毒素混合剂，麻疹减毒疫苗及乙型肝炎病毒疫苗接种的基础免疫。根据流行地区和季节，或根据家长自己的意愿，有时也进行乙型脑炎疫苗（B错）、流行性脑脊髓膜炎疫苗（C错）、风疹疫苗、流感疫苗（D错）、腮腺炎疫苗、甲型肝炎病毒疫苗（E错）、水痘疫苗、流感杆菌疫苗、肺炎疫苗、轮状病毒疫苗等的接种。预防接种的时间记为：出生乙肝卡介苗，二月脊灰炎正好，三四五月百白破，八月麻疹岁乙脑。根据此口诀可知，卡介苗为出生时就要实施的预防接种。